治疗急性梗阻性化脓性胆管炎的关键是
A. 取净胆道内结石
B. 抗菌药物治疗无效后再手术治疗
C. 纠正水电解质紊乱
D. 引流胆管
E. 使用多巴胺等药物扩张血管

正确答案：D。引流胆管

解析：急性梗阻型化脓性胆管炎的发病基础是胆道梗阻及细菌感染。如果在疾病发展过程中，胆道梗阻不能解除，胆管内细菌引起的感染得不到控制，将会危及患者生命。治疗急性梗阻型化脓性胆管炎的关键是引流胆管（D对），可阻断病情的恶化。当胆管内压力降低后，病人情况常常能暂时改善，如通过后续治疗病人一般情况得到恢复，宜在1～3个月后根据病因选择彻底的手术治疗，如取净胆道内结石（A错）。急性梗阻型化脓性胆管炎病情凶险，抗菌药物治疗无效后再手术治疗（B错）不能解决梗阻问题，非治疗关键。纠正水电解质紊乱（C错），使用多巴胺等药物扩张血管（E错）是急性梗阻型胆管炎的非手术治疗手段，无法彻底解除病因。